关于颅底骨折合并脑脊液漏预防感染的方法错误的是
A. 不可以做腰穿
B. 直接阻塞耳鼻漏
C. 取头高位卧床休息
D. 给予抗生素
E. 避免用力咳嗽

正确答案：B。直接阻塞耳鼻漏

解析：颅底骨折本身无需特别治疗，着重于观察有无脑损伤及处理脑脊液漏、脑神经损伤等并发症。合并脑脊液漏时，需预防颅内感染，不可堵塞或冲洗破口（B错，为本题正确答案），不做腰穿（A对），取头高位卧床休息（C对），避免用力咳嗽（E对）、打喷嚏和擤鼻涕，同时给予抗生素（D对）。保守治疗无效考虑手术修补。